放射诊疗工作人员应当按照有关规定配戴个人剂量计属于
A. 放射诊疗场所防护要求
B. 放射治疗的原则和实施
C. 对患者和受检者的防护要求
D. 放射诊疗工作人员防护要求
E. 放射诊疗设备和检测仪表的要求

正确答案：D。放射诊疗工作人员防护要求

解析：放射诊疗工作人员应当按照有关规定配戴个人剂量计。医疗机构应当按照有关规定和标准，对放射诊疗工作人员进行上岗前、在岗期间和离岗时的健康检查，定期进行专业及防护知识培训，并分别建立个人剂量、职业健康管理和教育培训档案。掌握“放射诊疗的防护与法律责任”知识点。